公共卫生的核心功能是什么
A. 预防疾病、宣传健康、职业病管理
B. 环境保护，预防传染病，保障卫生服务
C. 发布医疗卫生有关信息,促进卫生经济调控
D. 对灾难作出应急反应,保证卫生服务的有效性和及时性
E. 防治传染病，职业病管理，母婴保健

正确答案：A。预防疾病、宣传健康、职业病管理

解析：评估、制定政策、保障是公共卫生的三大核心功能（A对BCDE错）。